关黄柏的形状多为
A. 板片状
B. 单卷状
C. 筒状
D. 双卷筒状
E. 反曲状

正确答案：A。板片状

解析：本题考查的是皮类中药的形状。关黄柏的形状多为板片状（A对）。关黄柏：【性状鉴别】药材呈板片状或浅槽状，长宽不一。外表面黄绿色或淡棕黄色，较平坦，有不规则的纵裂纹，皮孔痕小而少见，偶有灰白色的粗皮残留；内表面黄色或黄棕色。体轻，质较硬，断面纤维性，有的呈裂片状分层，鲜黄色或黄绿色。气微，味极苦，嚼之有黏性。皮类中药的形状：由粗大老树上剥的皮，大多宽大而厚，呈长条状或板片状；枝皮则呈细条状或卷筒状；根皮多数呈短片状或筒状。一般描述术语有：（1）平坦状：皮片呈板片状（A错），较平整。如杜仲、黄柏。（2）弯曲状：皮片多向内表面弯曲，通常取自枝干或较小茎干的皮，易收缩而成弯曲状，由于弯曲的程度不同，又分为以下形状。①槽状或半管状：皮片向内弯曲呈槽状、浅槽状半圆形。如企边桂。②筒状（C错）或管状：皮片向内弯曲至两侧，接近呈管状，这类形状常见于加工时用抽心法抽去木心的皮类中药。如牡丹皮。③单卷筒状（B错）：皮片向一面卷曲，以至两侧重叠。如肉桂。④双卷筒状（D错）：皮片两侧各自向内卷成筒状。如厚朴。⑤复卷筒状：几个单卷或双卷的皮重叠在一起呈筒状。如锡兰桂皮。⑥反曲状（E错）：皮片向外表面略弯曲，皮的外层呈凹陷状。如石榴树皮。